下列描述队列研究与实验性研究相同点不正确的是
A. 费钱
B. 都可能产生失访偏倚
C. 都需要给予人为的干预措施
D. 都需设立对照组
E. 都是由因及果的研究方法

正确答案：C。都需要给予人为的干预措施

解析：本题考查队列研究和实验性研究的相同点。队列研究和实验性研究的相同点包括：①均耗费大量的人力、物力、财力（A对）；②都可能产生失访偏倚（B对）；③都需设立对照组（D对）；④都是由因及果的研究方法（E对）。实验性研究需要给予人为的干预措施，而队列研究属于分析性研究，不需要给予人为的干预措施（C错，为本题正确答案）。